在脊髓内经中继后下行传导束是
A. 脊髓丘脑侧束
B. 薄束
C. 锥体系
D. 脊髓小脑前束
E. 内侧纵束

正确答案：E。内侧纵束

解析：内侧纵束（E对）位于前索，为一复合的上、下行纤维的总合，在脑干起于不同的核团，进入脊髓的为内侧纵束降部，终于VII层、VIII层，中继后影响前角运动神经元。其作用主要是协调眼球的运动和头部的姿势。